吸氧1.5L/min，相当于多少氧浓度
A. 0.27
B. 0.32
C. 0.31
D. 0.35
E. 0.29

正确答案：A。0.27

解析：吸入氧浓度与氧流量的公式为：吸入氧浓度（%）=21+4×氧流量（L/min），将题干所给数据代入公式，吸入氧浓度（%）=21+4×1.5（L/min）=27％（A对）。